不寐的基本病机是
A. 本虚标实，气血失调
B. 阳盛阴衰，阴阳失调
C. 阳气不足，阴寒内盛
D. 气血凝滞，心脉痹阻
E. 气机逆乱，升降失常

正确答案：B。阳盛阴衰，阴阳失调

解析：心主神明，神安则寐，神不安则不寐。而阴阳气血之来源，由水谷之精微所化，上奉于心，则心神得养;受藏于肝，则肝体柔和；统摄于脾，则生化不息；调节有度，化而为精，内藏于肾，肾精上承于心，心气下交于肾，则神志安宁。故阴阳失调，则心神失养，导致不寐。故阳盛阴衰，阴阳失调是不寐的基本病机（B对）。本虚标实，本虚是指肝脾肾虚。标实是指气，血，痰，津液，水的壅结。一般，初期肝脾失调。正损不著，一标实为多后期肝脾损伤，病久及肾，以本虚为主，不是不寐的基本病机（A错）。阳气不足，阴寒内盛，不能温养脏腑，气血生化不足，气虚血少，与不寐的基本病机相反（C错）。气血凝滞，心脉痹阻，是指心脏脉络在某些致病因素作用下痹阻不通所表现的证候，主要临床表现：心悸怔忡，胸部憋闷疼痛，痛引肩背或手臂，时发时止（D错）。气机逆乱，升降失常，气机是指气的运动，即脏腑的功能，其形式为升、降、出、入，从生理上维护人体机能的平衡；从病理上，气机逆乱则病理产物骤生；故气机逆乱是气机失调的严重形式，不是不寐的基本病机（E错）。